细菌性肝脓肿致病菌最常见的侵入途径是
A. 门静脉
B. 肝总动脉
C. 肝静脉
D. 脐血管
E. 胆道系统

正确答案：E。胆道系统

解析：细菌最常通过胆道（21.6%～51.5%）（E对）进入肝脏，引起细菌性肝脓肿。致病菌可循门静脉（A错）、肝总动脉（B错）、脐血管（D错）途径进入肝脏，但这不是最常见途径。肝静脉（C错）血流出肝，致病菌极少经此途径侵入肝内。